下列关于问题和答案设计说法不正确的是
A. 对于事先不知道问题答案的情况可设置开放式问题
B. 对于等级问题，开放式问题比封闭式问题更能获得相对真实的回答
C. 封闭式问题更便于统计处理和分析
D. 封闭式问题可将不相干的回答减少到最小程度

正确答案：B。对于等级问题，开放式问题比封闭式问题更能获得相对真实的回答

解析：本题考查问题及答案的设计。根据问题是否预设答案，可将问题分为开放式和封闭式。对于事先不知道问题答案的情况可设置开放式问题（A对）。对于一些敏感的问题，如经济收入等，用等级资料的方式划出若干等级让回答者选择，封闭式问题往往比直接用开放式问题更能获得相对真实的回答（B错，为本题正确答案）。从资料的整理和分析方面看，封闭式问题列出答案种类，可以将不相干的回答减少到最小程度（D对），收集到的资料略去了回答者间的某些差异，统一归为若干类，便于分析和比较（C对）。